哪一项不是代谢性酸中毒时机体的代偿调节表现
A. HCO₃⁻不断被消耗
B. 细胞外液H+进入细胞内
C. 呼吸运动增强
D. 肾脏的排酸保碱功能减弱
E. 缓冲碱不断被消耗

正确答案：D。肾脏的排酸保碱功能减弱

解析：发生代谢性酸中毒时，血液中增多的H+ 立即被血浆缓冲系统进行缓冲，HCO₃⁻及其他缓冲碱不断被消耗（AE对），同时H+通过离子交换方式进入细胞内（B对）被细胞内缓冲系统缓冲，血液H+浓度增加可通过刺激颈动脉体和主动脉体化学感受器，反射性引起呼吸中枢兴奋，呼吸运动增强（E对），肾通过加强排酸保碱功能（D错，为本题正确答案）使HCO₃⁻在细胞外液的浓度有所恢复。